男，30岁，车祸致腹部闭合性损伤5小时，查体发现有下列阳性表现，其中提示腹部空腔脏器破裂的最主要依据是
A. 肝浊音界消失
B. 腹部压痛并反跳痛
C. 腹肌紧张
D. 肠鸣音消失
E. 腹式呼吸减弱

正确答案：B。腹部压痛并反跳痛

解析：腹部闭合性损伤，腹部空腔脏器破裂最主要的临床表现是腹膜炎，腹膜炎最典型的体征是腹部压痛、腹肌紧张和反跳痛（B对）。